覆盆子的功效是
A. 敛肺涩肠
B. 益肾固精
C. 温中行气
D. 敛疮生肌
E. 清热燥湿

正确答案：B。益肾固精

解析：本题考查覆盆子的功效。覆盆子的功效是益肾固精（B对）。覆盆子【功效】益肾，固精，缩尿，养肝，明目。诃子【功效】涩肠，敛肺（A错），下气，利咽。肉豆蔻【功效】涩肠止泻，温中行气（C错）。赤石脂【功效】涩肠止泻，止血，止带；外用收湿敛疮生肌（D错）。黄芩【功效】清热燥湿（E错），泻火解毒，止血，安胎。